牙体折断多见于上颌中切牙近中切角或切缘水平折断，牙本质折断者可出现牙齿敏感症状，有时近髓处透红、敏感，此为牙折的何种类型
A. 牙冠横折
B. 牙冠斜折
C. 牙冠纵折
D. 冠折未露髓
E. 冠折露髓

正确答案：D。冠折未露髓

解析：冠折未露髓：仅限于冠部釉质或釉质和牙本质折断，多见于上中切牙近中切角或切缘水平折断，偶见折断面涉及大部分唇面或舌面。牙本质折断者可出现牙齿敏感症状，有时可见近髓处透红、敏感。掌握“牙折”知识点。